疳证的基本病理改变为
A. 脾胃虚弱，运化失健
B. 脾胃虚弱，乳食停滞
C. 脾失运化，水湿内停
D. 脾胃不和，生化乏源
E. 脾胃受损，津液消亡

正确答案：E。脾胃受损，津液消亡

解析：小儿疳证的主要病变部位在脾胃，临床多因饮食不节、喂养不当、营养失调、疾病影响，以及先天禀赋不足所致，其基本病理改变为脾胃受损，津液消亡，而脾胃虚弱，运化失健，脾胃虚弱，乳食停滞，脾失运化，水湿内停，脾胃不和，生化乏源可导致呕吐，泄泻，厌食、积滞等病，不能导致疳证（E对）。